关于肾糖阈的定义正确的是
A. 尿中开始出现葡萄糖时的血糖浓度
B. 肾小球开始滤过葡萄糖时的血糖浓度
C. 肾小球开始吸收葡萄糖时的血糖浓度
D. 肾小管吸收葡萄糖的最大能力
E. 肾小球开始滤过葡萄糖的临界尿糖浓度

正确答案：A。尿中开始出现葡萄糖时的血糖浓度